肝素可用于
A. 抗血小板功能障碍
B. 体外抗凝
C. 弥漫性血管内凝血的高凝期
D. 防止血栓栓塞性疾病
E. 血小板减少性紫癜

正确答案：B、C、D。体外抗凝；弥漫性血管内凝血的高凝期；防止血栓栓塞性疾病

解析：本题考查肝素的作用。肝素为常用抗凝血药，体内外均有效（B对），可用于各种血栓栓塞性疾病（D对），也可用于弥漫性血管内凝血症的高凝期（C对）。肝素用药过量引起血小板减少性紫癜（E错），影响血小板功能（A错）。